结构中含有吡啶环
A. 辛伐他汀
B. 多巴酚丁胺
C. 二者均是
D. 二者均不是

正确答案：D。二者均不是